某地区有10万人口，1960年总死亡人数1000名，已发现的结核病患者有300名，男性200名，女性有100名，1960年有60名死于结核病，其中50名为男性，结核病的病死率
A. 0.06
B. 0.2
C. 0.02
D. 男女相等
E. 所给资料不能计算

正确答案：B。0.2

解析：本题考查病死率的计算。病死率＝某时期内因某病死亡人数/同期某病的病人数＝60/300×100%＝20%（B对ACDE错）。